下合穴主治的是
A. 慢性病证
B. 五脏病证
C. 六腑病证
D. 急性病证
E. 表里经脉病证

正确答案：C。六腑病证

解析：该题主要考查特定穴的应用。下合穴为六腑之气下合于下肢足三阳经的腧穴，又称六腑下合穴因此下合穴主要用于治疗六腑疾病（C对）其中原穴主要用于治疗相关脏腑的疾病；背俞穴用于治疗脏病、腹募穴用于治疗腑病；郄穴用于急性病证的治疗；络穴可治疗表里两经的病证。